高脂饮食能促进吸收的维生素有
A. 维生素A
B. 维生素C
C. 维生素D
D. 维生素E
E. 维生素K

正确答案：A、C、D、E。维生素A；维生素D；维生素E；维生素K

解析：本题考查维生素。高脂饮食能促进吸收的维生素有维生素A（A对）、维生素D（C对）、维生素E（D对）、维生素K（E对）。维生素A、维生素D、维生素E和维生素K为脂溶性维生素，易溶于脂肪和大多数有机溶剂，与脂肪吸收平行。